呼吸衰竭描述错误的是
A. 肺换气功能严重障碍
B. 静息状态下能维持足够的气体交换
C. 可出现低氧血症
D. 可不伴发高碳酸血症
E. 伴发高碳酸血症

正确答案：B。静息状态下能维持足够的气体交换

解析：呼吸衰竭是指各种原因引起的肺通气和（或）换气功能严重障碍，以致在静息状态下亦不能维持足够的气体交换，导致低氧血症伴（或不伴）高碳酸血症，进而引起一系列病理生理改变和相应临床表现的综合征。掌握“呼吸衰竭”知识点。